下列哪种不是锻丝卡环的种类
A. 单臂卡环
B. 双臂卡环
C. 三臂卡环
D. 圈形卡环
E. 杆型卡环

正确答案：E。杆型卡环

解析：本题考查局部义齿固位体。杆型卡环（E错，为本题正确答案）不是锻丝卡环。锻丝卡环的种类：单臂卡环（A对）、双臂卡环（B对）、三臂卡环（C对）、圈形卡环（D对）、连续卡环。